患者，女，59岁，全牙列缺失，全口义齿修复。初戴时检査发现义齿基托边缘未达到唇颊黏膜的转折处，如不修改，造成的主要后果为
A. 患者不适
B. 患者恶心
C. 不利于义齿的稳定.
D. 不利于义齿的固位
E. 不利于基托形成磨光面外形

正确答案：D。不利于义齿的固位

解析：全口义齿基托边缘未达到唇颊黏膜转折处，不易形成良好的边缘封闭，容易导致义齿脱落，不利于固位。掌握“全口义齿初戴”知识点。